以下除何穴外，都能治疗肾气亏虚型癃闭
A. 关元
B. 肾俞
C. 复溜
D. 血海
E. 太溪

正确答案：D。血海

解析：血海为癃闭实证瘀血阻滞证的穴位（D对）。关元为癃闭虚症主穴（A错）。肾俞为癃闭虚症主穴（B错）。复溜主治水肿、汗证等津液输布失调疾患，且为肾经穴位（C错）。太溪为癃闭虚症配穴（E错）。